女，45岁。突发右上腹疼痛6小时。发病前曾进食油腻食物，伴发热，无寒战。查体，T39.6℃，P130次／分，BP86/60mmHg，神志淡漠，巩膜黄染。心肺未见明显异常。右腹压痛、反跳痛。肌紧张阳性。实验室检查:WBC20×10⁹/L，总胆红素110μmol/L，直接胆红素78μmol/L.，腹部B超提示肝内外胆管扩张。该病人治疗的首要措施是
A. 胆道引流
B. 应用抗生素
C. 保护肝功能
D. 抗休克治疗
E. 解痉镇痛

正确答案：A。胆道引流

解析：患者中年女性，突发右上腹疼痛伴高热，低血压，诱因可能与发病前曾进食油腻食物相关，查体可见右腹压痛及反跳痛，腹肌紧张，实验室检查：WBC20×10⁹/L（正常值为4～10×10⁹ /L），TBil 110μmol/L （正常高值为17.1μmol/L），DBil 78μmol/L.（正常高值为6.8 μmol/L）（DBil/ TBil＞50%，提示为梗阻性黄疸），腹部B超提示肝内外胆管扩张，综合患者的病史、查体、实验室检查，该患者可考虑为急性重症胆管炎并发感染性休克。急性重症胆管炎的发病基础为胆道梗阻和细菌感染，而过高的胆道内压将促使细菌及胆汁通过损伤的胆管黏膜反流回血液，从而加重病情恶化，因此在急性重症胆管炎的治疗中应立即解除胆道梗阻并引流，即首先应进行胆道引流（A对），降低胆道压力，才有可能阻断胆汁及细菌反流回血液，中止病情恶化，并为抗休克治疗（D错）、应用抗生素抗感染治疗（B错）、保护肝功能（C错）、解痉镇痛（E错）解除梗阻争取时间。